组成挥发油的成分主要有
A. 单萜
B. 三萜
C. 倍半萜
D. 含氧倍半萜
E. 二倍半萜

正确答案：A、C、D。单萜；倍半萜；含氧倍半萜

解析：本题考查的是挥发油的组成成分。组成挥发油的成分主要有单萜（A对）、倍半萜（C对）与含氧倍半萜（D对）。挥发油的组成成分主要有四类。1.萜类化合物：萜类在挥发油的组成成分中所占比例最大，主要是单萜、倍半萜及其含氧衍生物。2.芳香族化合物：挥发油中的芳香族化合物多为小分子的苯丙素类衍生物，在挥发油中所占比例次于萜类，具有C₆-C₃骨架，且多为酚性化合物或其酯类。还有些是萜源化合物；有些是具有C₆-C₂或C₆-C₁骨架的化合物。3.脂肪族化合物：挥发油中的脂肪族化合物多为一些小分子化合物，包括醇、醛、酮、羧酸类等，其含量和作用一般不如萜类和芳香族化合物。4.其他类化合物：除以上三类化合物外，有些中药经过水蒸气蒸馏能分解出挥发性成分，也常称之为“挥发油”。三萜（B错）多以皂苷、树脂、植物乳汁等形式存在。二倍半萜（E错）多以海绵、植物病菌、昆虫代谢物等形式存在。